下列是医师在执业活动中的义务的是
A. 参加专业培训，接受继续医学教育
B. 关心、爱护、尊重患者，保护患者的隐私
C. 从事医学研究、学术交流，参加医师协会和专业学术团体
D. 获取工资报酬和津贴，享受国家规定的福利待遇
E. 在执业活动中，人格尊严、人身安全不受侵犯

正确答案：B。关心、爱护、尊重患者，保护患者的隐私

解析：医师在执业活动中的义务：医师在执业活动中履行下列义务：①遵守法律、法规，遵守技术操作规范；②树立敬业精神，遵守职业道德，履行医师职责，尽职尽责为患者服务；③关心、爱护、尊重患者，保护患者的隐私；④努力钻研业务，更新知识，提高专业技术水平；⑤宣传卫生保健知识，对患者进行健康教育。医师在执业活动中享有下列权利：①在注册的执业范围内，进行医学诊查、疾病调查、医学处置、出具相应的医学证明文件，选择合理的医疗、预防、保健方案；②按照国务院卫生行政部门规定的标准，获得与本人执业活动相当的医疗设备基本条件；③从事医学研究、学术交流，参加医师协会和专业学术团体；④参加专业培训，接受继续医学教育；⑤在执业活动中，人格尊严、人身安全不受侵犯；⑥获取工资报酬和津贴，享受国家规定的福利待遇；⑦对所在机构的医疗、预防、保健工作和卫生行政部门的工作提出意见和建议，依法参与所在机构的民主管理。掌握“医师执业规则及培训、考核及法律责任”知识点。